最大的一对脑神经是
A. 面神经
B. 三叉神经
C. 迷走神经
D. 舌下神经
E. 舌咽神经

正确答案：B。三叉神经

解析：三叉神经是脑神经中最大者，属混合性神经，是口腔颌面部主要的感觉神经和咀嚼肌的运动及本体感觉神经。有三条分支，分别为眼神经、上颌神经和下颌神经。掌握“三叉神经的分支与分布”知识点。